芒硝的安全成分检测
A. 可溶性汞盐
B. 三氧化二砷
C. 重金属和砷盐
D. 二氧化硫
E. 黄曲霉素

正确答案：C。重金属和砷盐

解析：本题考查的是芒硝的检查。芒硝的安全成分检测重金属和砷盐（C对）。芒硝【检查】铁盐与锌盐按《中国药典》方法不得发生浑浊或显蓝色。镁盐按《中国药典》方法，5分钟内不得发生浑浊。干燥失重减失重量应为51.0%～57.0%。重金属不得过百万分之十，砷盐不得过百万分之十。朱砂中的杂质主要是游离汞和可溶性汞盐（A错），后者毒性极大，为朱砂中的主要毒性成分，水飞可使朱砂中毒性汞含量下降，亦可降低铅和铁等金属的含量。雄黄【检查】三氧化二砷（B错）取本品0.94g，加稀盐酸20mL，不断搅拌30分钟，滤过，残渣用稀盐酸液洗涤2次，每次10mL，搅拌10mL，合并洗液与滤液置500mL量瓶中，加水至刻度，摇匀，精密量取10mL，置100mL量瓶中，加水至刻度，再精密量取2mL，加盐酸5mL与水21mL，按《中国药典》采用砷盐检查第一法检查，所显砷斑颜色不得深于标准砷斑。党参【检查】总灰分不得过5.0%，水分不得过16.0%；饮片水分不得过10.0%。二氧化硫（D错）残留量不得过400mg/kg。桃仁【检查】酸败度酸值不得过10.0，羰基值不得过11.0。黄曲霉毒素（E错）本品每1000g含黄曲霉毒素B₁不得过5μg，含黄曲霉毒素G₂、黄曲霉毒素G₁、黄曲霉毒素B₂和黄曲霉毒素B₁的总量不得过10μg。